女，37岁，慢性腹泻2年，大便每天2～3次，常带少量粘液，反复粪便致病菌培养阴性，结肠镜检查见为直肠降结肠和横结肠充血水肿，有少数散在浅溃疡。拟诊为溃疡性结肠炎。首选的治疗方案是
A. 泼尼松口服
B. 氟哌酸口服
C. 甲硝唑保留灌肠
D. 氢化可的松保留灌肠
E. 5-氨基水杨酸口服

正确答案：E。5-氨基水杨酸口服

解析：中青年女性患者，拟诊为溃疡性结肠炎，排便每天2～3次，无便血，属轻度（轻度：腹泻＜4次/日，便血轻或无，无发热，贫血无或轻，血沉正常），首选治疗方案是5-氨基水杨酸（E对）口服。糖皮质激素（A错）适用于对5-ASA（5-氨基水杨酸）疗效不佳的轻、中度患者，特别适用于重度患者（重度：腹泻＞6次/日，有明显黏液脓血便，体温＞37.5℃、脉搏＞90次/分，血红蛋白＜100g/L，血沉＞30mm/h）。该患者病变累及直肠、降结肠和横结肠，不宜用氢化可的松保留灌肠（氢化可的松保留灌肠适用于病变局限在直肠、乙状结肠患者）（D错）。氟哌酸（诺氟沙星）（B错）及甲硝唑（C错）为抗生素，不用于溃疡性结肠炎的治疗。